患者，女性，54岁。患风湿性二尖瓣关闭不全多年，用地高辛和氢氯噻嗪维持疗效，但近日呼吸困难加重，夜间频繁发作，心悸，两肺满肺野湿性罗音，经检查左室舒张期充盈压明显升高。除上述药物外，该加用哪种药物进行治疗
A. 米力农
B. 多巴胺
C. 硝普钠
D. 氨力农
E. 卡托普利

正确答案：C。硝普钠